尺骨
A. 上端有一向后的深凹称滑车切迹
B. 冠突内侧面有桡切迹
C. 下端参与腕关节
D. 尺骨茎突比桡骨茎突约低lcm
E. 滑车切迹的前下方的突起称冠突

正确答案：E。滑车切迹的前下方的突起称冠突

解析：尺骨上端粗大，前面有一半圆形深凹，称滑车切迹(A错)，切迹后上方的突起为鹰嘴, 前下方的突起为冠突（E对）。冠突外侧面有桡切迹（B错），尺骨下端为尺骨头,其前、外、后有环状关节面与桡骨的尺切迹相关节（C错）。生理情况下，尺骨茎突较桡骨茎突高约 1cm（D错）。